执业药师审方时，应关注中药与西药的联合使用，防止不合理联用情况的发生。可使磺胺类药物溶解性降低，导致结晶尿、血尿的是
A. 含钙较多的中药
B. 含汞的中药
C. 含有机酸的中药
D. 含水合性鞣质的中药
E. 含碱性成分的中药

正确答案：C。含有机酸的中药

解析：本题考查中西药联合在药动学上的相互作用。可使磺胺类药物溶解性降低，导致结晶尿、血尿的是含有机酸的中药（C对）。影响代谢：中西成药配伍时会影响药酶的活性，从而影响药物在体内的代谢。减少排泄：含有机酸成分的中药，如乌梅、山茱萸、陈皮、木瓜、川芎、青皮、山楂、女贞子等与磺胺类药物、利福平、阿司匹林等酸性药物合用时，因尿液酸化，可使磺胺类药物的溶解性降低，导致尿中析出结晶，引起结晶尿或血尿，增加磺胺类药物的肾毒性。中西药 不合理连用产生或增加不良反应：（1）含钙较多的中药（A错）及其制剂，如石膏、龙骨、牡蛎、珍珠、蛤壳及瓦楞子等，不可与洋地黄类药物合用，因钙离子为应激性离子，能增强心肌收缩力，抑制Na⁺，K⁺-ATP酶活性（也可以说与强心苷有协同作用），从而增强洋地黄类药物的作用和毒性。（2）含汞类中药及其制剂，如朱砂、轻粉、朱砂安神丸、仁丹、紫雪散、补心丹、磁朱丸等，不能与溴化钾、三溴合剂、碘化钾、碘喉片等同服，因汞离子与溴离子或碘离子在肠中相遇后，会生成有剧毒的溴化汞或碘化汞，从而导致药源性肠炎或赤痢样大便。（3）含汞的中药（B错）及其制剂，不能长期与含苯甲酸钠的咖溴合剂，或以苯甲酸钠作为防腐剂的制剂同服，因同服后可产生可溶性苯汞盐，引起药源性汞中毒。（4）含汞的中药及其制剂，不能与具有还原性的西药如硫酸亚铁、亚硝酸异戊酯同服，同服后能使Hg²⁺“还原成Hg⁺”，毒性增强。（5）含汞中药及其制剂，不能与巴比妥联用，同服后可产生可溶性苯汞盐，引起药源性汞中毒。（6）含水合型鞣质（D错）而对肝脏有一定毒性的诃子、五倍子、地榆、四季青等，以及含有这些药物的中成药，不能与对肝脏有一定毒性的西药四环素、利福平、氯丙嗪、异烟肼、依托红霉素等联用，因联用后会加重对肝脏的毒性，导致药源性肝病的发生。（7）含碱性成分的中药（E错）及其制剂，不能与氨基糖苷类西药合用，因这些中药及其制剂能使机体对氨基糖苷类抗生素吸收增加，排泄减少，虽能提高抗生素的抗菌药力，但却增加了其在脑组织中的药物浓度，使耳毒性作用增强，从而影响前庭功能，导致暂时或永久性耳聋及行动蹒跚。（8）含碱性成分的中药及其制剂，不能与奎尼丁同用，因其能使碱化，增加肾小管对奎尼丁的重吸收，从而便排泄减少，血药浓度增加，引发奎尼丁中毒。